治疗顽固性心力衰竭首先进行的处理是
A. 做血液超滤
B. 使用非洋地黄类强心药
C. 联合应用利尿剂
D. 静脉应用血管扩张剂
E. 寻找病因

正确答案：E。寻找病因

解析：部分心力衰竭患者尽管已使用各种药物治疗（BCD错），但休息时仍有症状，有心源性恶病质，且需长期、反复住院，即为顽固性心力衰竭。对于此类患者，需积极寻找病因（E对），然后针对病因进行治疗。血液超滤（A错）治疗，是指用机械装置从外周或中心静脉把血液抽出，通过第二个泵产生的静水压对血浆进行过滤，过滤后再输送回患者静脉的过程，可用于治疗顽固性心力衰竭，但并非首先进行的处理。